将骨骼肌中生成的氨转运至肝的主要氨基酸是
A. 脯氨酸
B. 丙氨酸
C. 缬氨酸
D. 亮氨酸
E. 甘氨酸

正确答案：B。丙氨酸